对氯丙嗪叙述错误的是
A. 对刺激前庭引起的呕吐有效
B. 可使正常人体温下降
C. 可加强苯二氮草类药物的催眠作用
D. 可阻断脑内多巴胺受体
E. 可抑制糖皮质激素的分泌

正确答案：A。对刺激前庭引起的呕吐有效